盐酸普鲁卡因与生物大分子的键合形式不包括
A. 范德华力
B. 疏水性相互作用
C. 共价键
D. 偶极-偶极作用
E. 静电引力

正确答案：C。共价键

解析：本题考查药物与生物大分子相互作用的方式。盐酸普鲁卡因与生物大分子的键合形式是可逆的结合形式，为非共价键键合类型，而共价键（C错，为本题正确答案）为不可逆的键合类型。非共价键键合形式包括：范德华力（A对）、氢键、疏水性相互作用（B对）、静电引力（E对）、电荷转移复合物、偶极‒偶极作用（D对）等。